根据无牙颌各部分组织结构特点及与全口义齿的关系，无牙颌被分为以下四区，除了
A. 主承托区
B. 副承托区
C. 边缘封闭区
D. 后堤区
E. 缓冲区

正确答案：D。后堤区

解析：本题考查无牙颌的功能分区。后堤区（D错，为本题的正确答案）是前后颤动线之间，作为上颌义齿后缘的封闭区。根据无牙颌的组织结构和全口义齿的关系，将无牙颌分为四个区，即主承托区（A对）、副承托区（B对）、边缘封闭区（C对）和缓冲区（E对）。主承托区是垂直于（牙合）力受力方向的区域，承担义齿的大部分咀嚼压力；副承托区是（牙合）力受力方向成角度的区域，协助主承托区承担咀嚼压力；缓冲区需要缓冲咀嚼压力的地方，避免义齿修复后出现黏膜压痛；边缘封闭区是义齿边缘接触的软组织部分，与义齿的固位密切相关。